学龄儿肥胖症主要是
A. 脂肪细胞数目增加
B. 骨骼肌细胞数目增加
C. 脂肪细胞体积增加
D. 骨骼肌细胞体积增加
E. 体内液体量增加

正确答案：C。脂肪细胞体积增加

解析：学龄儿肥胖症主要是脂肪细胞体积增加，由饮食因素、运动因素、遗传因素等引起（C对A错）。骨骼肌细胞的数量是通过锻炼增加（B错）。骨骼肌细胞体积增加是由于乳酸积累过多（D错）。抗利尿激素分泌增加，作用于肾脏远曲小管和集合管上皮细胞，对水的再吸收作用加强，尿量减少，水分得到保留（E错）。